仅限于二级以上医院内使用的是
A. 盐酸哌替啶
B. 罂粟壳
C. 盐酸二氢埃托啡
D. 人参

正确答案：C。盐酸二氢埃托啡

解析：本题考查特殊药品处方管理。仅限于二级以上医院内使用的是盐酸二氢埃托啡（C对）。《处方管理办法》第二十六条规定，对于需要特别加强管制的麻醉药品，盐酸二氢埃托啡处方为一次常用量，仅限于二级以上医院内使用；盐酸哌替啶（A错）处方为一次常用量，仅限于医疗机构内使用。罂粟壳（B错），必须盖有乡镇卫生院以上医疗机构公章的医生处方配方使用，不准生用，严禁单味零售，处方保存3年备查。